肝浊音界消失常见于
A. 膈下脓肿
B. 急性肝坏死
C. 急性胃肠穿孔
D. 肝癌
E. 肺气肿

正确答案：C。急性胃肠穿孔